作用于胰岛β细胞上ATP敏感钾离子通道的口服降糖药是
A. 恩格列净
B. 吡格列酮
C. 阿格列汀
D. 格列喹酮
E. 米格列醇

正确答案：D。格列喹酮

解析：本题考查口服降糖药。格列喹酮（D对）的受体是胰岛β细胞上ATP感的钾离子通道（K-ATP通道）的一部分。